女孩，10岁。全身水肿2周。尿蛋白定量4.5g/24h。血浆白蛋白20g/L，血脂升高。行肾脏穿刺活检，光镜下肾小球未见异常。电镜下肾小球最可能的病理变化是
A. 脏层上皮细胞足突消失
B. 系膜区电子致密物沉积
C. 上皮下驼峰样电子致密物沉积
D. 基底膜弥漫性增厚
E. 基底膜内电子致密物沉积

正确答案：A。脏层上皮细胞足突消失

解析：患者青少年，全身水肿，尿蛋白＞3.5g/24h，血浆白蛋白＜30g/L，血脂升高。据患者年龄、症状及实验室检查，考虑诊断为肾病综合征。儿童肾病综合征最常见的原因是微小病变性肾病。病变特点是弥漫性肾小球脏层上皮细胞足突消失（A对）。系膜区电子致密物沉积（B错）见于系膜增生性肾小球肾炎。上皮下驼峰样电子致密物沉积（C错）见于急性弥漫性增生性肾小球肾炎。基底膜弥漫性增厚（D错）见于膜性肾小球病。基底膜内电子致密物沉积（E错）见于膜增生性肾小球肾炎Ⅰ型（P274表13-2原发性肾小球疾病特点）。